性凉，既利尿通淋又清热除湿退黄的是
A. 冬葵子
B. 地肤子
C. 海金沙
D. 灯心草
E. 广金钱草

正确答案：E。广金钱草

解析：本题考查的是广金钱草的性味归经与功效。性凉，既利尿通淋又清热除湿退黄的是广金钱草（E对）。广金钱草：【性味归经】甘、淡，凉。归肝、肾、膀胱经。【功效】清热除湿，利尿通淋，退黄。冬葵子（A错）：【性味归经】甘，寒。归大肠、小肠、膀胱经。【功效】利水通淋，下乳，润肠通便。地肤子（B错）：【性味归经】甘、苦、辛，寒。归肾、膀胱经。【功效】利尿通淋，祛风止痒。海金沙（C错）：【性味归经】甘、淡，寒。归膀胱、小肠经。【功效】利尿通淋，止痛。灯心草（D错）：【性味归经】甘、淡，微寒。归心、肺、小肠经。【功效】利尿通淋，清心除烦。